芳基丙酸类非甾体抗炎药
A. 贝诺酯
B. 安乃近
C. 吲哚美辛
D. 布洛芬
E. 吡罗昔康

正确答案：D。布洛芬